患者，男，53岁，因胸痛发作且持续不缓解就诊。诊断为冠心病，急性非ST段抬高型心肌梗死。宜选用的治疗药物是
A. 达比加群酯
B. 利伐沙班片
C. 替格瑞洛片
D. 阿司匹林肠溶片
E. 注射用尿激酶

正确答案：D。阿司匹林肠溶片

解析：本题考查冠心病的药物治疗。随机对照临床试验（RCT）证实慢性稳定型心绞痛患者服用阿司匹林（D对）可降低心肌梗死、脑卒中或心血管性死亡的发生风险，所有冠心病患者如无用药禁忌均应服用。冠心病二级预防时，阿司匹林肠溶片的最佳剂最范围为75～150mg/d。不能耐受阿司匹林的患者可改用氯吡格雷作为替代治疗。目前尚无指南推荐替格瑞洛可用于替代阿司匹林。